下面哪项不是煤工尘肺的主要病理改变
A. 煤斑
B. 肺气肿
C. 煤矽结节
D. 弥漫性纤维化
E. 胸膜斑

正确答案：E。胸膜斑

解析：本题考查煤工尘肺的病理特点。多数人为混合型尘肺，大多数有间质性弥漫纤维化和结节型两者特征（CD对）。煤斑是煤工尘肺最常见的原发性特征性病变（A对）。灶周肺气肿是煤工尘肺病理的又一特征（B对）。胸膜斑（E错，为本题正确答案）见于石棉肺。